治疗气虚型子宫脱垂，应首选的方剂是
A. 大补元煎
B. 归脾汤
C. 八珍汤
D. 举元煎
E. 补中益气汤

正确答案：E。补中益气汤

解析：气虚型子宫脱垂，是由于久泻久痢，或劳累太过，或孕育过多，产后失养导致脾虚气陷，升举无力，因此宜用具有补益中气，升阳举陷功效的补中益气汤（E对）；大补元煎具有补肾固脱，益气升提的功效，可以用于治疗子宫脱垂的肾气虚亏证，症见阴中有物脱出，久脱不复，腰酸腿软，头晕耳鸣，小便频数或不利，小腹下坠。舌质淡苔薄，脉沉弱（A错）；归脾汤具有益气补血，健脾养心的功效，主治心脾气血两虚证，症见心悸怔忡，健忘失眠，盗汗，体倦食少，面色萎黄，舌淡，苔薄白，脉细弱（B错）；八珍汤具有益气补血之功效，主治气血两虚证，症见面色苍白或萎黄，头晕耳眩，四肢倦怠，气短懒言，心悸怔忡，饮食减少，舌淡苔薄白，脉细弱或虚大无力（C错）；举元煎具有益气升提的功效，主治气虚下陷、血崩血脱、亡阳垂危等证（D错）。